除另外规定外，含毒性药品的中药酊剂每100ml相当于原饮片
A. 10g
B. 20g
C. 50g
D. 100g
E. 200g～500g

正确答案：A。10g

解析：本题考查的是酊剂的质量要求。除另外规定外，含毒性药品的中药酊剂每100ml相当于原饮片10g（A对）。酊剂：系指原料药物用规定浓度的乙醇提取或溶解而制成的澄清液体制剂，也可用流浸膏稀释制成。除另有规定外，普通中药酊剂每100ml相当于原饮片20g（B错）。含有毒性药品的中药酊剂，每100ml应相当于原饮片10g。流浸膏剂、浸膏剂系指饮片用适宜的溶剂提取，蒸去部分或全部溶剂，调整至规定浓度而制成的制剂。除另有规定外，流浸膏剂要求每1ml相当于饮片1g（D错）。浸膏剂分为稠膏和干膏两种，每1g相当于饮片2～5g。